男，51岁，重症肺炎患者，入院后次日病情加重，突发持续性呼吸急促，发绀，伴烦躁，呼吸频率38次/分，心率108次/分，律齐，两肺可闻及湿啰音。血气分析：pH7.34，PaO₂50mmHg，PaCO₂30mmHg。胸片示两中下肺纹理增多模糊，斑片状阴影，心胸比例正常。为缓解病人的呼吸困难，最好采用
A. 高频通气
B. 持续气道正压通气（CAPA）
C. 呼气末正压通气（PEEP）
D. 高浓度吸氧
E. 双气道正压通气（Bi-PAP）

正确答案：C。呼气末正压通气（PEEP）

解析：患者为中老年男性，患有重症肺炎（重症肺炎为急性呼吸窘迫综合征的危险因素），入院后次日病情加重，突发持续性呼吸急促，发绀，伴烦躁，呼吸频率38次/分，心率108次/分，律齐，两肺可闻及湿啰音，血气分析：pH34，PaO₂50mmHg（正常为＞60mmHg），PaCO₂30mmHg（正常为35～45mmHg）（符合ARDS的典型改变为PaO₂降低，PaCO₂降低），胸片示两中下肺纹理增多模糊，斑片状阴影，符合成人呼吸窘迫综合征（ARDS）的临床表现及辅助检查，诊断为ARDS，故应尽早进行机械通气，包括合适水平的呼气末正压通气（PEEP）（C对）和小潮气量。高频通气（A错）可用于急性呼吸衰竭的治疗。高浓度吸氧（D错）可用于不伴CO₂潴留的低氧血症。双气道正压通气（Bi-PAP）（E错）主要用于多种急、慢性呼吸衰竭的治疗。